男，45岁。低热，头痛，嗜睡3天，随后出现兴奋话多，言语零乱，说在墙壁上看到了妖怪，有人要害他等，既往体健。患者可能的症状是
A. 妄想状态
B. 躁狂状态
C. 谵妄状态
D. 紧张状态
E. 幻觉状态

正确答案：C。谵妄状态

解析：该患者低热（谵妄的病因），头痛，嗜睡3天（意识障碍），随后（起病急骤）出现兴奋话多，言语零乱，看到墙壁上有妖怪（幻觉），有人要害他（被害妄想）等，既往体健，诊断根据患者起病急骤，因低热引起意识障碍，出现幻觉、妄想，故患者最可能是谵妄状态（C对）。